职业中毒分为几种临床类型
A. 急性、亚急性2种
B. 急性、慢性2种
C. 急性、亚急性、慢性3种
D. 轻度、中度、重度3种
E. 轻度、重度2种

正确答案：C。急性、亚急性、慢性3种